与别嘌醇存在药物相互作用，合用时需减量的药物是
A. 甲氨蝶呤
B. 曲妥珠单抗
C. 长春新碱
D. 环磷酰胺
E. 巯嘌呤

正确答案：E。巯嘌呤

解析：本题考查药物的相互作用。与别嘌醇存在药物相互作用，合用时需减量的药物是巯嘌呤（E对）。与别嘌醇同时服用时，由于后者抑制巯嘌呤的代谢，明显地增加巯嘌呤的效能与毒性，因此在两药同时服用的过程中，应仔细观察药物的不良反应，并适当减少巯嘌呤的剂量至常用量的1/4～1/3。甲氨蝶呤（A错）吸收之后与血清白蛋白部分结合，由于其结合能被某些药物替代例如水杨酸盐、磺胺类药、磺酰脲、保泰松和苯妥英，故毒性反应可能会增加。临床试验显示曲妥珠单抗（B错）与其他药物合并用药后，未发现有临床意义的相互作用。长春新碱（C错）与苯妥英钠合用，会降低苯妥英钠吸收，或使代谢亢进。环磷酰胺（D错）可使血清中胆碱酯酶减少，使血清尿酸水平增高，因此，与抗痛风药如别嘌呤醇、秋水仙碱、丙磺舒等同用时，应调整抗痛风药物的剂量。此外也加强了琥珀胆碱的神经肌肉阻滞作用，可使呼吸暂停延长。